一颌面外伤患者，经检查发现外耳道流血性液体，渐转清亮液体。该液体很可能是脑脊液，对下述哪类脑损伤有诊断意义
A. 脑震荡
B. 硬脑膜外血肿
C. 颅中窝骨折
D. 颅前窝骨折
E. 脑挫裂伤

正确答案：C。颅中窝骨折

解析：本题考查颅脑损伤。颅中窝骨折（C对），常出现脑脊液耳漏。脑震荡（A错）是头面部外伤后即刻发生的短暂性意识障碍，属于轻度脑损伤。硬脑膜外血肿（B错）的典型表现是昏迷后一度意识清醒或好转，随后又转入嗜睡、昏迷，伤侧瞳孔散大，对光反射消失，呼吸、脉搏变慢，血压升高。颅前窝骨折（D错），常引起脑脊液鼻漏。脑挫裂伤（E错）可出现意识障碍，因脑水肿和高颅压导致剧烈头痛和恶心呕吐。